小儿腹泻发病率高的年龄组是
A. ＜3月
B. 3月～5月
C. 6月～2岁
D. 3岁～4岁
E. 5岁～6岁

正确答案：C。6月～2岁

解析：小儿腹泻好发于6个月～2岁婴幼儿（C对），其中1岁以内约占50%。